女，35岁，闭经2年。检查发现双侧乳房触发溢乳。首选检测的指标是
A. PRL
B. FSH
C. ACTH
D. GH
E. TSH

正确答案：A。PRL

解析：该患者为中青年女性，闭经2年，检查发现双侧乳房触发溢乳（对出现月经紊乱及不育、溢乳、闭经、多毛、青春期延迟者，应考虑为高催乳素血症），考虑为高催乳素血症。为明确诊断，首选检测指标是PRL（催乳素）（A对），若血清催乳素＞1.14nmol/L（25µg/L）可确诊。FSH（卵泡刺激素）（B错）和LH（黄体生成素）一起用于鉴别闭经原因，若FSH及LH水平低于正常值，提示闭经原因在腺垂体或下丘脑，若FSH及LH水平高于正常值，提示病变部位在卵巢；ACTH（促肾上腺皮质激素）（C错）的测定主要用于下丘脑-垂体-肾上腺轴功能的检测；GH（生长激素）（D错）的测定主要用于巨人症及侏儒症的诊断；TSH（促甲状腺激素）（E错）的测定主要用于甲状腺疾病的诊断。以上四项均不是首选检测指标。